大气颗粒物是指
A. 固体颗粒
B. 液体颗粒
C. 尘埃细粒
D. 固体颗粒和液体颗粒
E. 固体颗粒和尘埃细粒

正确答案：D。固体颗粒和液体颗粒

解析：本题考查大气颗粒物。大气颗粒物是大气中存在的各种固态和液态颗粒状物质的总称（D对ABCE错）。各种颗粒状物质均匀地分散在空气中构成一个相对稳定的庞大的悬浮体系，即气溶胶体系，因此大气颗粒物也称为大气气溶胶。